青春期龈炎的临床表现不包括
A. 龈缘和龈乳头颜色暗红或鲜红
B. 好发于唇侧牙龈缘和牙间乳头，舌侧少见
C. 好发于舌侧牙龈缘和牙间乳头，唇侧少见
D. 龈乳头呈球形突起
E. 牙龈探诊出血明显

正确答案：C。好发于舌侧牙龈缘和牙间乳头，唇侧少见

解析：本病好发于前牙唇侧的牙龈乳头和龈缘，舌侧牙龈较少发生。唇侧牙龈肿胀较明显，龈乳头常呈球状突起，颜色暗红或鲜红、光亮、质地软、探诊出血明显。龈沟可加深形成龈袋，但附着水平无变化，亦无牙槽骨吸收。患者的主诉症状常为刷牙或咬硬物时出血，口臭等。掌握“青春期龈炎”知识点。